通过正确的刷牙方法刷牙可以达到的效果主要是
A. 使口气清新
B. 按摩牙龈
C. 促进牙龈组织的血液循环
D. 清除牙菌斑
E. 清除食物残渣

正确答案：D。清除牙菌斑

解析：刷牙是每个人常规的自我口腔保健措施，是机械性去除菌斑和软垢最常用的有效方法。故正确的刷牙方法可以达到有效去除菌斑的目的。掌握“自我口腔保健方法”知识点。